可升高白细胞，用于化疗所致的中性粒细胞减少症的药品是
A. 硫酸亚铁
B. 重组人血促素
C. 维生素B₁₂
D. 人血白蛋白
E. 非格司亭

正确答案：E。非格司亭

解析：本题考查非格司亭。非格司亭（E对）临床适用于肿瘤化疗等原因导致中性粒细胞减少症。